属于Ⅱ型超敏反应性疾病的是
A. 新生儿溶血
B. 血清病
C. 荨麻疹
D. 过敏性鼻炎
E. 过敏性休克

正确答案：A。新生儿溶血

解析：Ⅱ型超敏反应又称溶细胞型或细胞毒型超敏反应，主要引起以细胞溶解或组织损伤为主的病理性免疫反应，发作较快。临床常见疾病有1.输血反应2.新生儿溶血症（A对）3.自身免疫型溶血性贫血4.药物过敏性血细胞减少症5.肺出血-肾炎综合征。血清病（B错）属于Ⅲ型超敏反应。荨麻疹（C错）、过敏性鼻炎（D错）、过敏性休克（E错）均属于Ⅰ型超敏反应性疾病。